最初形成釉质的矿化中心可能是下列哪种结构中的蛋白质
A. 牙本质牙骨质界
B. 釉梭
C. 釉质牙骨质界
D. 釉丛
E. 釉质牙本质界

正确答案：E。釉质牙本质界

解析：釉牙本质界处的蛋白质可能是最初形成釉质的矿化中心。掌握“牙釉质”知识点。